妊娠剧吐的痰湿阻滞证的治疗方剂为
A. 香砂六君子汤
B. 橘皮竹茹汤
C. 小半夏加茯苓汤
D. 生脉散合增液汤
E. 干姜人参半夏丸

正确答案：C。小半夏加茯苓汤

解析：妊娠剧吐的痰湿阻滞证主因孕妇脾阳素虚，水湿不化，痰饮内停，复因孕后血聚养胎，冲气较盛，冲气挟痰湿上逆犯胃，胃失和降，而致妊娠恶阻，治宜和胃止呕，引水下行，方用补中降逆之小半夏加茯苓汤（C对）。香砂六君子汤（A错）为治疗妊娠恶阻之脾胃虚弱证的方药；橘皮竹茹汤（B错）为治疗妊娠恶阻之肝胃不和证的方药；妊娠恶阻之气阴两虚治宜生脉散合增液汤（D错）；干姜人参半夏丸（E错）主治脾胃不和之妊娠呕吐。